除另有规定外，有效成分制备中药注射剂其纯度应不低于
A. 0.1
B. 0.2
C. 0.45
D. 0.8
E. 0.9

正确答案：E。0.9

解析：本题考查的是中药注射用原料。除另有规定外，有效成分制备中药注射剂其纯度应不低于0.9（E对）。按照《中药、天然药物注射剂基本技术要求》的规定，有效成分制成的中药注射剂，主药成分含量应不少于90%；多成分制成的中药注射剂，所测成分应大于总固体量的80%（D错）。0.1（A错）为含有毒性药品的中药酊剂的浓度。含有毒性药品的中药酊剂，每100ml应相当于原饮片10g。不高于0.2（B错）为合剂的含糖量。合剂若加蔗糖，除另有规定外，含糖量一般不高于20%（g/ml）。不低于0.45（C错）的为糖浆剂含糖量。糖浆剂含蔗糖量应不低于45%（g/ml）。